苯二氮卓类药物作用特点为
A. 对快动眼睡眠时相影响大
B. 没有抗惊厥作用
C. 没有抗焦虑作用
D. 停药后代偿性反跳较重
E. 可缩短睡眠诱导时间

正确答案：E。可缩短睡眠诱导时间

解析：苯二氮卓类属于镇静催眠药，其药理作用和临床应用：1.抗焦虑作用（C错），通过对边缘系统中的BZ受体的作用而实现的，对各种原因引起的焦虑均有显著疗效，主要用于焦虑症。2.镇静催眠作用，能明显缩短入睡时间（E对），显著延长睡眠持续时间，减少觉醒次数；主要延长非快动眼睡眠的第2期，对快动眼睡眠的影响较小（A错）；其依赖性和戒断症状较轻微（D错）。3.抗惊厥（B错）、抗癫痫作用，临床可用于辅助治疗破伤风、子痫、小儿高热惊厥及药物中毒性惊厥。